具有泻下，清肝，杀虫功效的药物是
A. 番泻叶
B. 大黄
C. 芒硝
D. 甘遂
E. 芦荟

正确答案：E。芦荟

解析：该题考查芦荟的功效，属记忆内容。芦荟味苦，性寒，归肝、胃、大肠经，具有泻下通便，清肝，杀虫的功效（E对）。